不宜与赤石脂及其制剂同时服用的中成药是
A. 归脾丸
B. 六味地黄丸
C. 桂附地黄丸
D. 补中益气丸
E. 知柏地黄丸

正确答案：C。桂附地黄丸

解析：本题考查的是配伍禁忌。不宜与赤石脂及其制剂同时服用的中成药是桂附地黄丸（C对）。桂附地黄丸所含肉桂与赤石脂相反，故不宜联用。十九畏列述了九组十九味相反药，具体是：硫黄畏朴硝（包括芒硝、玄明粉），水银畏砒霜，狼毒畏密陀僧，巴豆（包括巴豆霜）畏牵牛子（包括黑丑、白丑），丁香（包括母丁香）畏郁金，川乌（包括附子）、草乌畏犀角，芒硝（包括玄明粉）畏三棱，官桂畏石脂，人参畏五灵脂。归脾丸（A错）、六味地黄丸（B错）、补中益气丸（D错）与知柏地黄丸（E错）中均不含肉桂，故与赤石脂及其制剂无配伍禁忌。